男，22岁，大学生。平常乐于助人、尊师爱校。不仅在学习上经常帮助同学，而且在生活上也常常照顾他人，并能积极组织班级的集体活动。这种行为方式在性格的特征中属于
A. 行为特征
B. 意志特征
C. 态度特征
D. 情绪特征
E. 理智特征

正确答案：C。态度特征

解析：性格的结构可以分为四个维度的特征，分别是态度特征、意志特征、理智特征、情绪特征。态度特征（C对）是指个体在对现实生活各个方面的态度中表现出来的一般特征。题中同学乐于助人、尊师爱校的行为方式属于性格的态度特征。理智特征（E错）是指个体在认知活动中表现出来的心理特征。情绪特征（D错）是指个体在情绪表现方面的心理特征。意志特征（B错）是指个体在调节自己的心理活动时表现出的心理特征。